男，32岁。反复活动时气短三年余，加重伴双下肢水肿2周，无发热。查体：BP100/60mmHg，心率120次/分，颈静脉怒张，双肺可闻及湿性啰音，心界明显向两侧扩大，心尖部可闻及舒张早期奔马律和2/6级收缩期吹风样杂音。该患者最可能的诊断是
A. 心包炎
B. 扩张型心肌病
C. 肥厚型心肌病
D. 风湿性心脏瓣膜病
E. 缺血性心肌病

正确答案：B。扩张型心肌病

解析：患者中年男性，反复活动时气短3年余，加重伴双下肢水肿（提示右心衰竭）2周，无发热。查体：双肺底可闻及湿性啰音（提示左心衰竭），颈静脉怒张，心尖部可闻及舒张早期奔马律和2/6级收缩期吹风样杂音（提示左心室扩大导致的相对性二尖瓣关闭不全），心界明显向两侧扩大（扩张型心肌病典型体征），综合患者的病史、临床表现和体格检查，该患者最可能的诊断是扩张型心肌病（B对）。心包炎（A错）患者出现大量心包积液时，虽然也可出现心界向两侧扩大，但其典型表现为Beck三联征：低血压、心音低弱、颈静脉怒张，且一般无心脏杂音。肥厚型心肌病（C错）（P266）心界一般不大或仅左室增大，主要特征为心室不对称肥厚而无心室腔增大，典型杂音为胸骨左缘第3～4肋间较粗糙的喷射性收缩期杂音。风湿性心脏瓣膜病（D错）患者多有风湿热病史，且多在年幼时发病，并伴有相应瓣膜区的改变。缺血性心肌病（E错）多有情绪激动、劳累时心前区疼痛，常表现为胸闷、乏力、眩晕或呼吸困难等症状。